为判断冷冻食品是否被人或温血动物粪便污染，可检测
A. 大肠菌群
B. 沙门氏菌
C. 葡萄球菌
D. 肠球菌
E. 乳酸杆菌

正确答案：D。肠球菌

解析：本题考查判断冷冻食品是否被人或温血动物粪便污染的指标。为判断冷冻食品是否被人或温血动物粪便污染，可检测肠球菌（D对ABCE错）。